心动周期中，主动脉压的最高值与最低值之差是
A. 舒张压
B. 循环系统平均充盈压
C. 平均动脉压
D. 收缩压
E. 脉压

正确答案：E。脉压

解析：心动周期中，主动脉压的最高值与最低值之差即收缩压（D错）和舒张压（A错）的差值为脉压（E对）。循环系统平均充盈压（B错）可用来表示循环系统中血液的充盈程度。平均动脉压（C错）则为一个心动周期中每一瞬间动脉血压的平均值。